患者，男，68岁。诊断为支气管肺癌。唇甲紫暗，咯痰不爽，胸痛胀满气急，舌有瘀点，脉弦。其证型是
A. 气滞血瘀
B. 痰湿毒蕴
C. 阴虚毒热
D. 气阴两虚
E. 阴阳两虚

正确答案：A。气滞血瘀

解析：患者患有支气管肺癌，血瘀不能荣养肌肤故见唇甲紫暗；气滞痰凝则咯痰不爽；气滞血阻，脉络不和，积而成块故见胸痛胀满气急；舌有瘀点为血瘀表现，脉弦为气滞的特点，故可诊断为气滞血瘀证（A对）。痰湿毒蕴证（B错）的表现为咳嗽痰多，胸闷气短，肺中积块，可见胸胁疼痛，纳差便溏，神疲乏力。阴虚毒热（C错）的表现为咳嗽，无痰或少痰，或痰中带血，甚则反复咯血，肺中积块，心烦少寐，手足心热，或低热盗汗，或邪热炽盛。气阴两虚证（D错）的表现为咳嗽无力，有痰或无痰，或痰中带血，肺中积块，神疲乏力，时有心悸，汗出气短，口干，发热或午后潮热，手足心热，纳呆脘胀。阴阳两虚证（E错）的表现为咳嗽气短，动则尤甚，腰膝酸软，手足心热，自汗盗汗，面浮肢肿，唇紫肢冷，形寒或见五更泄泻。